对医务人员进行道德评价的首要标准是看其医疗行为是否有利于
A. 患者疾病的缓解和康复
B. 医学科学的发展和社会的进步
C. 人类生存环境的保护和改善
D. 减轻患者及其家庭的经济负担
E. 优生和人群的健康、长寿

正确答案：A。患者疾病的缓解和康复

解析：“防病治病，救死扶伤”是医德基本手段，“医学人道主义”是医学道德基本要求，“全心全意”是医学道德的最高要求，“为人民健康服务”是医学道德的价值目标。